在卫生毒理学试验中，反映毒物急性毒性最有实用意义的指标是
A. 死亡率
B. 半数致死剂量
C. 病理学变化
D. 生物化学变化
E. 剂量-效应关系

正确答案：B。半数致死剂量